下列哪个评价方法在我国已作为一种法律制度在新建、扩建和改建的工程项目中给予执行
A. 区域环境质量评价
B. 回顾性环境质量评价
C. 环境健康效应评价
D. 环境影响评价
E. 单因素环境质量评价

正确答案：D。环境影响评价